体内维生素E主要储存在
A. 肝脏
B. 肾脏
C. 骨骼
D. 肌肉
E. 脂肪

正确答案：E。脂肪